下列结构通常不位于肾窦内的是
A. 肾大盏
B. 肾小盏
C. 肾盂
D. 肾动脉分支
E. 输尿管

正确答案：E。输尿管

解析：肾窦内主要结构有肾血管（D对）、肾小盏（B对）、肾大盏（A对）、肾盂（C对）和脂肪等。输尿管（E错，为本题正确答案）起于肾盂下端，位于肾窦外。